用于治疗躁狂症的药物是
A. 氯丙嗪
B. 丙咪嗪
C. 司来吉兰
D. 哌替啶
E. 碳酸锂

正确答案：E。碳酸锂

解析：本题考查碳酸锂的临床应用。碳酸锂（E对）为抗精神病类的药物，可以用于治疗躁狂症。